治疗疥疮的常用药物是
A. 硫磺软膏
B. 肌轻松软膏
C. 黄连素软膏
D. 三黄洗剂
E. 青黛膏

正确答案：A。硫磺软膏

解析：疥疮是由疥虫（疥螨）寄生在人体皮肤所引起的一种接触传染性皮肤病。其临床特点是夜间剧痒，在皮损处有灰白色、浅黑色或普通皮色的隧道，可找到疥虫。内治治法以清热化湿，解毒杀虫为主。方药：黄连解毒汤合三妙丸加减。外治以杀虫为主，硫黄治疗疥疮，古今皆为常用特效药物。临床多与水银、雄黄等杀虫药配用，以油调敷，或与大枫子、蓖麻仁等有油脂之果仁捣膏用之。目前临床常用浓度5%～20%的硫黄软膏（A对），儿童酌情减量。